能引起全口多数牙牙冠（牙合）面降低的原因是
A. 龋病
B. 外伤
C. 磨损
D. 楔状缺损
E. 发育畸形

正确答案：C。磨损

解析：本题考查牙体缺损的病因-磨损。能引起全口多数牙牙冠（牙合）面降低的原因是磨损（C对）。龋病（A错）会引起牙齿色形质的改变，不给予治疗会导致牙髓和根尖周的病变。牙外伤（B错）包括牙震荡，牙脱位（部分脱位、嵌入性脱位、完全脱位），嵌入性脱位可使临床牙冠变短，但不会使全口牙冠（牙合）面降低。楔状缺损（D错）是牙齿唇、颊面颈部慢性硬组织缺损。发育畸形（E错）是牙发育和形成过程中结构和形态异常，常见有釉质发育不全、牙本质发育不全、四环素牙和氟斑牙，不会导致全口牙冠（牙合）面降低。